男，44岁。肝区疼痛2个月。呈持续性钝痛，放射至右肩背部，消瘦、乏力。查体：巩膜无黄染，肝肋下3cm，质地稍硬，有结节感。AFP800μg/L。B超示肝右叶8cm×6cm占位病变，向外生长，周边血流量增强；门静脉正常。最理想的治疗方法是
A. 肿瘤切除加放疗
B. 姑息性肝切除术
C. 根治性肝切除术
D. 肝动脉化疗栓塞
E. 局部射频治疗

正确答案：C。根治性肝切除术

解析：患者中年男性，B超示肝右叶肿块，AFP800μg/L（AFP＞400μg/L考虑肝癌），诊断为肝癌。患者癌肿局限于肝右叶，向外生长，门静脉正常（无癌栓形成），最理想的治疗方法是根治性肝切除术（C对）。肿瘤切除加放疗（A错）临床效果不如根治性肝切除术，且在临床肝癌治疗中应用较少。姑息性肝切除术（B错）适用于不能做根治性肝切除术的患者。肝动脉化疗栓塞（D错）主要用于不可切除的肝癌或切除后的辅助性治疗。局部射频治疗（E错）适用于不宜手术或不需要手术治疗的肝癌。